依法为病人提供安全、有效、经济的优质药品和药学服务体现了
A. 药学职业道德的权利
B. 药学职业道德的义务
C. 药学职业道德的节操
D. 药学职业道德的良心
E. 药学职业道德的情感

正确答案：A。药学职业道德的权利